供水单位卫生许可证的颁发部门是
A. 县级以上地方人民政府卫生行政主管部门
B. 县级以上质量技术监督部门
C. 县级以上环保部门
D. 县级以上建设部门
E. 县级以上人民政府食品药品监督管理部门

正确答案：A。县级以上地方人民政府卫生行政主管部门